依据机体辐射剂量与临床类型判断，对放射损伤较为敏感的器官（组织）是
A. 骨髓
B. 脑干
C. 胃肠
D. 肝肾
E. 皮肤

正确答案：A。骨髓

解析：本题考查对放射损伤较为敏感的器官（组织）。当外照射急性放射病的吸收剂量在1.0～10.0Gy时，暴露者会出现轻、中、重、极重骨髓型表现。依据机体辐射剂量与临床类型判断，对放射损伤较为敏感的器官（组织）是骨髓（A对BCDE错）。